反应停对大小鼠剂量达4000mg/kg时几乎无致畸作用，而0.5～1.0mg/kg剂量即对人有致畸作用
A. 实验动物的物种与毒效应
B. 实验动物的品系与毒效应
C. 实验动物的性别与毒效应
D. 实验动物的年龄与毒效应
E. 实验动物的生理营养状况与毒效应

正确答案：A。实验动物的物种与毒效应